如在急性吸入毒性实验当中，随着苯的浓度越来越高，各试验组的小鼠死亡率也相应增高，这说明存在
A. 量反应关系
B. 质反应关系
C. 剂量-量反应关系
D. 剂量-质反应关系

正确答案：D。剂量-质反应关系

解析：本题考查剂量-质反应关系。如在急性吸入毒性实验当中，随着苯的浓度越来越高，各试验组的小鼠死亡率也相应增高，这说明存在剂量-质反应关系（D对ABC错）。